女孩，1岁，因智力发育落后来院。查体：T36.5℃，P110次/分，R28次/分，表情呆滞，眼距宽。眼外眦上斜。鼻梁塌，舌常伸出口外，心肺腹部未见异常，小指向内弯曲，通贯手。为明确诊断，首选的检查是
A. 骨龄
B. 血T₃、T₄
C. 血氨基酸分析
D. 血TSH
E. 染色体核型分析

正确答案：E。染色体核型分析

解析：患儿，智力发育落后，并且表情呆滞，眼距宽，眼外眦上斜，鼻梁塌，舌常伸出口外的特殊面容，最可能的诊断是唐氏综合症，唐氏综合症是染色体病性遗传病，因此，确诊方法是染色体核型分析（E对）。骨龄（A错）在临床上有重要的诊断价值，如甲状腺功能减退症、生长激素缺乏症骨龄明显延后，真性性早熟、先天性肾上腺皮质增生症骨龄超前。血T₃、T₄、TSH是甲亢或甲减的确诊方法（BD错）。血氨基酸分析（C错）多用于诊断氨基酸代谢病，如苯丙酮尿症等。